属于选择性α₂受体激动剂，可增加房水经葡萄膜巩膜通路外流而降低眼压的药物是
A. 拉坦前列素
B. 溴莫尼定
C. 托吡卡胺
D. 噻吗洛尔
E. 毛果芸香碱

正确答案：B。溴莫尼定

解析：本题考查降眼压药的分类及作用机制。溴莫尼定（B对）属于选择性α₂受体激动剂，可增加房水经葡萄膜巩膜通路外流而降低眼压。拉坦前列素（A错）是一种选择性前列腺素受体激动剂，能通过增加房水流出而降低眼压。托吡卡胺（C错）属于抗胆碱药，能阻滞乙酰胆碱引起的虹膜括约肌及睫状肌兴奋作用，可引起散瞳和睫状肌麻痹。噻吗洛尔（D错）属于β受体阻断剂，可促进房水排出而降低眼压。毛果芸香碱（E错）属于拟M胆碱药，激动M胆碱受体可缩小瞳孔，促使前房角开放而降低眼压。